病毒在活体内或细胞培养中，被特异性抗体中和而失去感染性的一种试验，称为
A. 放射免疫试验
B. 蛋白印迹试验
C. 酶联免疫吸附试验
D. 血凝抑制试验
E. 中和试验

正确答案：E。中和试验

解析：中和试验是指病毒在活体内或细胞培养中，被特异性抗体中和而失去感染性的一种试验。掌握“病毒感染检查方法及防治原则”知识点。